国家对一部分体外诊断试剂按照药品进行管理，另一部分按照医疗器械管理。下列体外诊断试剂按照医疗器械管理的有
A. 新型冠状病毒（2019-nCoV）抗体检测试剂（用于抗体检测）
B. 丙型肝炎病毒抗体检测试剂（用于血源筛查检测）
C. EB病毒核酸检测试剂（用于病毒感染核酸检测）
D. 丙氨酸氨基转移酶（ALT）检测试剂（用于血液生化指标检测）

正确答案：A、C、D。新型冠状病毒（2019-nCoV）抗体检测试剂（用于抗体检测）；EB病毒核酸检测试剂（用于病毒感染核酸检测）；丙氨酸氨基转移酶（ALT）检测试剂（用于血液生化指标检测）

解析：本题考查医疗器械的界定。国家对一部分体外诊断试剂按照药品进行管理，另一部分按照医疗器械管理。下列体外诊断试剂按照医疗器械管理的有新型冠状病毒（2019-nCoV）抗体检测试剂（用于抗体检测）（A对）、EB病毒核酸检测试剂（用于病毒感染核酸检测）（C对）、丙氨酸氨基转移酶（ALT）检测试剂（用于血液生化指标检测）（D对）。目前国家对体外诊断试剂的注册管理分为两类，其中用于血源筛查（B错）和采用放射性核素标记的体外诊断试剂按照药品进行管理，其他体外诊断试剂均按照医疗器械进行管理。